某些中药可引起肝损害。其中可导致肝肿大、黄疸的中药是
A. 半夏
B. 苦杏仁
C. 罂粟壳
D. 苍耳子
E. 香加皮

正确答案：D。苍耳子

解析：本题考查的是中药饮片的不良反应。某些中药可引起肝损害。其中可导致肝肿大、黄疸的中药是苍耳子（D对）。苍耳子的不良反应表现：①消化系统：恶心、呕吐，腹痛、腹泻，重者可见黄疸、肝肿大、消化道出血等。②神经系统：头痛、头晕等。③循环系统：胸闷、心慌气短、血压下降、心律失常、房室传导阻滞等。④呼吸系统：呼吸困难、呼吸节律不整、肺水肿等。⑤泌尿系统：水肿、少尿、尿闭、血尿、尿失禁、肾功能异常、急性肾功能衰竭等。⑥其他：见于报道的还有血小板减少性紫癜、神经性水肿、声哑、喉头水肿、喉梗塞等。半夏（A错）有毒，内服一般炮制后使用，3～9g。外用适量，磨汁涂或研末以酒调敷患处。不宜与川乌、制川乌、草乌、制草乌、附子同用；生品内服宜慎。苦杏仁（B错）不良反应表现：苦杏仁的主要成分苦杏仁苷是其有效成分也是中毒成分，误服过量苦杏仁可发生氢氰酸中毒，使延髓等生命中枢先抑制后麻痹，并抑制细胞色素氧化酶的活性而引起组织窒息。临床表现为眩晕、心悸、恶心、呕吐等中毒反应，重者出现昏迷、惊厥、瞳孔散大、对光反应消失，最后因呼吸麻痹而死亡。罂粟壳（C错）的不良反应表现：罂粟壳中含有的主要成分是吗啡、可待因、罂粟碱等，罂粟壳中毒与其所含的主要成分吗啡有关。其临床表现为昏睡或昏迷，抽搐，呼吸浅表而不规则，恶心、呕吐、腹泻，面色苍白，发绀、瞳孔极度缩小呈针尖样，血压下降等。目前文献报道的病例报告中，罂粟碱中毒均体现在婴幼儿中，可能因为婴儿中枢神经系统、肝、肾、酶系统等发育未成熟，对中药较敏感，易引起中毒。香加皮（E错）的不良反应表现：①消化系统：主要为恶心、呕吐、腹泻等胃肠道症状。②心血管系统：主要为心律失常，如心率减慢、早搏、房室传导阻滞等。动物毒性实验表明香加皮中毒后多表现为血压先升而后下降、心肌收缩力增强、每分钟心输出量增加，继而心输出量减弱、心律失常，乃至心肌纤颤而死亡。